医德修养的主要内容是指
A. 卫生行政部门提出的要求
B. 医院院长提出的要求
C. 病人提出的要求
D. 新闻媒体提出的要求
E. 医德原则、规范提出的要求

正确答案：E。医德原则、规范提出的要求